不属于较大突发环境污染事件（Ⅲ级）的构成条件的是
A. 发生3人以上、10人以下死亡
B. 中毒（重伤）50人以下
C. 造成跨地（市）级行政区域纠纷
D. 造成跨县（市）级行政区域纠纷
E. 3类放射源丢失、被盗或失控

正确答案：D。造成跨县（市）级行政区域纠纷

解析：本题考查较大突发环境污染事件（Ⅲ级）的构成条件。凡符合下列情形之一者，可定为较大突发环境污染事件（Ⅲ级）：1.发生3人以上、10人以下死亡（A对），或中毒（重伤）50人以下（B对）；因环境污染造成跨地级（C对）行政区域纠纷（D错，为本题正确答案），使经济、社会活动受到影响；3.3类放射源丢失、被盗或失控（E对）。